下列哪一种气体属于化学窒息气体
A. 氯气
B. 氨气
C. 一氧化碳
D. 二氧化氮

正确答案：C。一氧化碳

解析：本题考查化学窒息气体。化学窒息性气体是指进入机体后可对血液或组织产生特殊化学作用，使血液对氧的运送、释放或组织利用氧的能力发生障碍，引起组织细胞缺氧窒息的气体。如一氧化碳（C对）、硫化氢、氰化氢、苯胺等。氯气（A错）、氨气（B错）和二氧化氮（D错）属于刺激性气体，不属于化学窒息气体。